患者，女，25岁，已婚。有盆腔炎病史，下腹部疼痛结块，缠绵日久，痛连腰骶，经行加重，经血量多有块，带下量多，精神不振，纳少乏力，舌质紫黯有瘀点，苔白，脉弦涩无力。治疗应首选
A. 理冲汤
B. 膈下逐瘀汤
C. 少腹逐瘀汤
D. 血府逐瘀汤
E. 银甲丸

正确答案：A。理冲汤

解析：题中患者有盆腔炎病史，主症为下腹部疼痛结块，缠绵日久，痛连腰骶，故诊断为慢性盆腔炎。瘀血内结，留著于冲任胞宫，故下腹部疼痛结块，缠绵日久，痛连腰骶；经期胞宫满溢，瘀滞更甚，故疼痛加重，经血量多有块；有盆腔炎病史，病久气血耗伤，中气不足，故精神不振，纳少乏力；气虚津液不化，水湿下注，故带下量多。舌质紫黯有瘀点，苔白，脉弦涩无力为气虚血瘀之象，故辨为气虚血瘀证，治宜益气健脾，化瘀散结，方选理冲汤（A对）。膈下逐瘀汤为慢性盆腔炎气滞血瘀证的选方，功能活血化瘀，理气止痛（B错）。少腹逐瘀汤功能活血祛瘀，温经止痛，主治寒凝血瘀证（C错）。血府逐瘀汤功能活血化瘀，行气止痛，主治胸中血瘀证（D错）。银甲丸为慢性盆腔炎湿热瘀结证的选方，功能清热利湿，化瘀止痛（E错）。